为了评价活检对乳腺癌诊断的预测值，对400例患乳腺癌的妇女和400名正常的妇女进行活检诊断，结果是前者中350例阳性，后者100例阳性。该诊断试验的阳性预测值为
A. 0.12
B. 0.25
C. 0.33
D. 0.67
E. 0.778

正确答案：E。0.778